下列临床表现中最不支持心绞痛诊断的是
A. 疼痛可在睡眠中发生
B. 含服硝酸甘油，疼痛在3～5分钟内缓解
C. 疼痛易被运动或情绪激动诱发
D. 反复出现的局限性心前区刺痛，每次持续仅2～3秒
E. 疼痛在休息时发生，持续1～10分钟

正确答案：D。反复出现的局限性心前区刺痛，每次持续仅2～3秒

解析：反复出现局限性心前区刺痛，每次持续仅2～3秒符合心脏神经症的临床特点（D错，为本题正确答案）。稳定型心绞痛（P219）的发病机制主要是冠状动脉存在固定狭窄或部分闭塞的基础上发生需氧量的增加。疼痛易被运动或情绪激动诱发（C对）。心绞痛一般持续数分钟至十余分钟，多为3～5分钟，舌下含用硝酸甘油能在几分钟内缓解（B对）。不稳定型心绞痛（P229）的发病机制是动脉粥样硬化不稳定斑块破裂或糜烂导致冠状动脉内血栓形成。疼痛性质与稳定型心绞痛相似，但程度更重，持续时间更长，疼痛可在休息时发生，持续1～10分钟（E对），也可在睡眠中发生（A对），表现为静息或夜间心绞痛。